关于楔束哪一种说法是不正确的
A. 位于薄束的外侧
B. 贯穿脊髓的全长
C. 在脊髓后索内上升
D. 传导上半身的本体感觉
E. 也传导上半身的精细触觉

正确答案：B。贯穿脊髓的全长

解析：腰部楔束起自同侧第4胸节及以上的脊神经节细胞（B错，为本题正确选项），位于后索的外侧部（A对）。薄、楔束传导同侧躯干及上下肢的肌、腿、关节的本体感觉（位置觉、运动觉和震动觉）和皮肤的精细触觉（如通过触摸辨别物体纹理粗细和两点距离）信息（DE对）。